我国甲药品批发企业代理了某国乙药品生产商生产的疫苗，该疫苗在销售中出现了重大安全隐患，应实根据《药品召回管理办法》，该召回行为的主体应是
A. 国家食品药品监督管理局
B. 疫苗销售地省级药品监督管理部门
C. 甲药品批发企业所在地省级药品监督管理部门
D. 甲药品批发企业
E. 乙药品生产商

正确答案：E。乙药品生产商

解析：本题考查药品的召回管理。我国甲药品批发企业代理了某国乙药品生产商生产的疫苗，该疫苗在销售中出现了重大安全隐患，应实根据《药品召回管理办法》，该召回行为的主体应是乙药品生产商（E对）。药品经营企业（D错）、使用单位发现其经营、使用的药品存在安全隐患的，应当立即停止销售或者使用该药品，通知药品生产企业或者供货商，并向药品监督管理部门报告。